口腔结核抗结核化疗方案中长程（标准）化疗药物不包括
A. 异烟肼
B. 链霉素
C. 利福平
D. 乙胺丁醇
E. 对氨柳酸

正确答案：E。对氨柳酸

解析：本题考查抗结核药。口腔结核抗结核化疗方案中长程（标准）化疗药物不包括对氨柳酸（E错，为本题的正确答案）。抗结核化疗方案中长程（标准）化疗药物包括异烟肼（A对）；链霉素（B对）；利福平（C对）；乙胺丁醇（D对）；不包括对氨柳酸。